下唇的主要感觉神经来自
A. 舌下神经
B. 面神经
C. 下颌神经
D. 上颌神经
E. 舌神经

正确答案：C。下颌神经

解析：下颌神经中的感觉神经分布于面下部及颊部皮肤、下唇、耳及外耳道、颞区、舌前2/3、下颌牙、乳突小房、颊部黏膜、下颌骨及颅中凹的硬脑膜。掌握“口腔境界及唇、颊的局部解剖”知识点。